男，1个月。出生体重3.5kg，呕吐1周。生后3周左右开始溢乳，逐日加重呈喷射性呕吐，奶汁带凝块，不含胆汁。查体：体重3.5kg，皮肤轻度黄染，前囟稍凹，心肺无异常，上腹部蠕动波，右季肋下肿块，质较硬，光滑，移动。最可能的原因是
A. 喂养不当
B. 胃食管反流
C. 幽门痉挛
D. 先天性肥厚性幽门狭窄
E. 胃扭转

正确答案：D。先天性肥厚性幽门狭窄

解析：患儿有无胆汁的喷射性呕吐、上腹部蠕动波、右季肋下肿块的临床表现，是先天性肥厚性幽门狹窄的典型临床表现，应诊断为先天性肥厚性幽门狹窄（D对）。喂养不当是由于喂奶过急、过多引起的一过性吐奶，并没有胃蠕动波和右上腹肿块的临床表现（A错）。胃食管反流的呕吐物中含有胆汁（B错）。幽门痉挛只是在痉挛的时候才会有胃蠕动波和右上腹肿块，在痉挛间期不会有胃蠕动波和右上腹肿块（C错）。胃扭转可以引起呕吐，但此病引起的呕吐与体位的改变有关（E错）。